A和B两种药物的CRH分别为71.0%和82.0%，两者等量混合的CRH（%）值是
A. 11
B. 17.4
C. 34.8
D. 58.2
E. 69.6

正确答案：D。58.2

解析：本题考查CRH的计算。混合物的CRH约等于各药物CRH的乘积，与各组分的比例无关，故混合后CRH（%）=71.0%×82.0%=58.2（C对）。